症见胸闷心悸，气短不得卧，舌苔薄白，脉数，应诊断为
A. 悬饮
B. 支饮
C. 溢引
D. 痰饮
E. 皮水

正确答案：B。支饮

解析：痰饮有广义和狭义之分，广义痰饮包括痰饮、悬饮、溢饮、支饮。支饮病在肺脏，主要表现为咳逆倚息，短气不得卧（B对）。悬饮病在胸胁，有明显的胁肋部的不适，咳嗽时会引起胸胁疼痛（A错）。狭义痰饮病在肠胃，以脘痞、肠鸣、吐清涎为主（D错）。溢饮病在四肢，以四肢肿胀重痛为主症（C错）。皮水其脉亦浮，外证胕肿，按之没指，不恶风，其腹如鼓，不渴（E错）。